属于药物代谢第Ⅱ相反应的是
A. 氧化
B. 脱卤素
C. 水解
D. 还原
E. 乙酰化

正确答案：E。乙酰化

解析：本题考查药物化学结构与第Ⅱ相生物转化的规律。乙酰化（E对）属于药物代谢第Ⅱ相反应。第Ⅱ相生物转化是将第Ⅰ相中药物产生的极性基团与体内的内源性成分，如葡萄糖醛酸、硫酸、甘氨酸或谷胱甘肽，经共价键结合，生成极性大、易溶于水和易排出体外的结合物。氧化（A错）、脱卤素（B错）、水解（C错）、还原（D错）属于药物代谢第Ⅰ相反应。第Ⅰ相生物转化，也称为药物的官能团化反应，是体内的酶对药物分子进行的氧化、还原、水解、羟基化等反应。